在整个反射弧中，最易出现疲劳的部位是
A. 感受器
B. 传入神经元
C. 反射中枢中的突触
D. 传出神经元
E. 效应器

正确答案：C。反射中枢中的突触